再生障碍性贫血确诊的细胞学检查是
A. 骨髓活检
B. 骨髓细胞学检查
C. 血常规
D. 外周血涂片
E. 脑脊液

正确答案：B。骨髓细胞学检查

解析：骨髓细胞学检查（B对）再生障碍性贫血确诊的细胞学检查；骨髓活检（A错）反映骨髓造血组织的结构、增生程度、细胞成分和形态变化；血常规检查（C错）可以确定有无贫血，贫血是否伴白细胞或血小板数量的变化；外周血涂片（D错）可观察红细胞、白细胞、血小板数量或形态改变，有否疟原虫和异常细胞；脑脊液检查（E错）一般不用于血液系统疾病的检查。